女，28岁。间断下腹痛4年余，大便2～3次/日，稀便，无脓血，便后下腹痛可缓解。粪常规检查：未见细胞，隐血试验阴性，查体无异常发现。该患者最可能的诊断是
A. 溃疡性结肠炎
B. 克罗恩病
C. 肠结核
D. 肠易激综合征
E. 慢性细菌性痢疾

正确答案：D。肠易激综合征

解析：青年女性患者，间断下腹痛（肠易激综合征腹痛常位于下腹或左下腹）4年余（病程6个月以上），大便2～3次/日（排便频率异常），稀便（粪便性状异常），无脓血（肠易激综合征患者粪便绝无脓血），便后腹痛可缓解（符合肠易激综合征的腹痛特点）。粪常规检查：未见细胞，隐血试验阴性。查体无异常发现（肠易激综合征患者一般无异常体征）。综合该患者的病史、实验室检查，考虑诊断为肠易激综合征（D对）。溃疡性结肠炎（P374）（A错）患者有黏液脓血便。克罗恩病（P377）（B错）临床以腹痛、腹泻、体重下降、腹块、瘘管形成和肠梗阻为特点。肠结核（P368）（C错）多有发热、盗汗等结核毒血症状。慢性细菌性痢疾（E错）有黏液脓血便，粪检可见白细胞及红细胞。